胆道蛔虫病的疼痛
A. 阵发性绞痛
B. 持续性疼痛
C. 持续性疼痛阵发性加剧
D. 持续闷胀痛
E. 钻顶样绞痛

正确答案：E。钻顶样绞痛

解析：胆道蛔虫症主要表现为常突发剑突下钻顶样剧烈绞痛（E对），阵发性加剧，放射至右肩胛或背部。腹痛可骤然缓解，间歇期可全无症状。阵发性绞痛（A错）常见于胆囊结石（P439），其主要表现为胆绞痛，位于右上腹或上腹部，呈阵发性或者持续性疼痛伴阵发性加剧。持续性疼痛（B错）常见于急性胰腺炎（P457），其主要表现为腹痛多位于左上腹，疼痛剧烈，呈持续性，可向左肩及左腰背部放射。持续性疼痛阵发性加剧（C错）常见于急性胆囊炎（P443），其主要表现为上腹部疼痛，开始时仅有上腹胀痛不适，逐渐发展至阵发性绞痛；疼痛放射到右肩、肩胛和背部。持续闷胀痛（D错）常见于肝内胆管结石（P442），其主要表现为可多年无症状或仅有上腹和胸背部胀痛不适。